男孩，3岁。左侧阴囊包块，呈球形，光滑，无触痛，睾丸触摸不清，透光试验阳性。可能的诊断为
A. 股沟斜疝
B. 精索鞘膜积液
C. 睾丸肿瘤
D. 睾丸鞘膜积液
E. 交通性鞘膜积液

正确答案：D。睾丸鞘膜积液

解析：患儿左侧阴囊包块，球形光滑无触痛，透光试验阳性（提示鞘膜积液），综上考虑诊断为睾丸鞘膜积液。股沟斜疝（A错）和睾丸肿瘤（C错）不会有透光试验阳性。精索鞘膜积液（B错）可表现为一个或多个囊肿，呈椭圆形、梭形或哑铃形，沿精索而生长，其下方可扪及正常睾丸。交通性鞘膜积液（E错）立位时阴囊肿大，卧位时积液流人腹腔，鞘膜囊缩小或消失，题干中没有该类信息，故不选。